关于高血压的病因，哪一种说法是错误的
A. 与神经精神因素有关
B. 与肥胖有关
C. 与嗜盐习惯无关
D. 与吸烟有关
E. 与遗传有关

正确答案：C。与嗜盐习惯无关